具有凉血解毒功效的药物是
A. 大黄
B. 芒硝
C. 芦荟
D. 火麻仁
E. 桃仁

正确答案：A。大黄

解析：该题目考查大黄的功效，属记忆内容。大黄味苦，性寒；入脾、胃、大肠、肝、心包经；其功效为泻下攻积，清热泻火，凉血解毒，逐瘀通经（A对）。芒硝具有泻下攻积，润燥软坚，清热消肿的功效，无凉血解毒之功（B错）。芦荟具有泻下通便，清肝，杀虫的功效（C错）。火麻仁具有润肠通便的功效（D错）。桃仁为活血调经药，具有活血祛瘀，润肠通便，止咳平喘的功效，无凉血解毒的功效（E错）。